某一细胞群体杀伤肿瘤细胞机制为：①释放溶酶体酶直接杀伤；②ADCC效应；③分泌TNF等细胞因子。该细胞是
A. Mφ
B. NK
C. Tc
D. LAK
E. TIL

正确答案：A。Mφ